疗效优于乙琥胺，但因有肝毒性，仅在癫痫小发作合并大发作时作为首选的药物是
A. 苯巴比妥
B. 丙戊酸钠
C. 卡马西平
D. 苯妥英钠
E. 扑米酮

正确答案：B。丙戊酸钠

解析：本题考查丙戊酸钠。疗效优于乙琥胺，但因有肝毒性，仅在癫痫小发作合并大发作时作为首选的药物是丙戊酸钠（B对）。丙戊酸钠为一广谱抗癫痫药，临床用于各型癫痫，对失神性发作（小发作）疗效最好，强于乙琥胺。严重毒性为肝损害，在用药期间应定期检查肝功能。苯巴比妥（A错）是治疗癫痫强直阵挛发作（大发作）的首选药之一。卡马西平（C错）对癫痫复杂部分性发作有良效，为首选药。苯妥英钠（D错）为治疗大发作和局限性发作的首选药，对复杂部分性发作和单纯部分性发作有一定疗效。扑米酮（E错）主要用于癫痫强直阵挛发作（大发作），也可用于部分性发作。